医疗机构从业人员的职业道德手段是
A. 大医精诚
B. 以患者为中心
C. 人道行医
D. 为人民健康服务
E. 救死扶伤

正确答案：E。救死扶伤

解析：医疗机构从业人员的职业道德手段是救死扶伤（E对），为人民健康服务是医疗机构从业人员的职业价值目标（D错）。